需要与传染病鉴别时，应特别注意询问的是
A. 胎产史
B. 喂养史
C. 生长发育史
D. 预防接种史
E. 家族史

正确答案：D。预防接种史

解析：小儿为稚阴稚阳之体，形气未充，御邪能力较弱，为疫毒之邪的易感群体，接种疫苗为预防传染病的主要手段，故需要与传染病鉴别时，应特别注意询问预防接种史（D对）。